普萘洛尔抗心律失常的主要作用是
A. 治疗量的膜稳定作用
B. 扩张血管，减轻心脏负荷
C. 消除精神紧张
D. 加快心率和传导
E. 阻断心脏的β受体，降低自律性，减慢心率

正确答案：E。阻断心脏的β受体，降低自律性，减慢心率

解析：普萘洛尔属于β受体激动剂，能阻断窦房结β受体，防止交感神经活动对4相除极速度和异位起搏的影响，降低窦房结、心房、浦肯野纤维自律性，对运动、情绪激动或窦房结功能异常而引起的心率加快，使心率明显减慢（E对）。有些β受体阻断药可降低细胞膜对离子的通透性，成为膜稳定作用，无膜稳定性作用的β受体阻断药也具有抗心律失常的作用，因此普萘洛尔膜稳定作用（A错）与抗心律失常无关系。普萘洛尔对于血管β₂受体有阻断作用，使α受体作用占优势，加上心脏抑制后反射性兴奋交感神经，引起血管收缩，心脏负荷增加（B错）。普萘洛尔对中枢无明显影响，不能消除精神紧张（C错）。普萘洛尔阻断心脏β₁受体，使心率减慢、心肌收缩力减弱、心输出量减少、心肌耗氧量下降、血压稍降低，还能减慢心房和房室结的传导（D错）。